女，55岁。左乳房红肿、增大1个月，进展较快，无疼痛、发热。查体：左乳房红肿，局部温度略高，发硬，但未触及包块，左腋窝有肿大淋巴结，稍硬，活动度好，无压痛。血常规正常。最可能的诊断是
A. 乳腺增生症
B. 急性乳腺炎
C. 乳房结核
D. 导管内乳头状瘤
E. 炎性乳腺癌

正确答案：E。炎性乳腺癌

解析：中年女性患者（乳腺癌好发年龄段），左乳房红肿、增大1个月，进展较快（提示恶性病变），无疼痛、发热（提示非感染性疾病）。查体：左乳房红肿，局部温度略高，发硬（炎症样表现），左腋窝无痛性淋巴结肿大（提示病变侵犯淋巴结）。血常规正常（提示非感染性疾病）。综合该患者的病史、体查及实验室检查，诊断考虑炎性乳腺癌（E对）。乳腺增生症（A错）多发于中年妇女，主要表现为乳房胀痛及肿块，无腋窝淋巴结肿大。急性乳腺炎（P240）（B错）多见于产后哺乳期妇女，主要表现为乳房疼痛，局部红肿、发热，并有寒战、高热、脉快等感染中毒症状，外周血白细胞升高。乳房结核（C错）多见于20～40岁妇女，病程较长，进展缓慢，早期表现为乳房内一个或数个无痛性结节，与周围组织分界不清。导管内乳头状瘤（P242）（D错）多见于40～45岁经产妇，主要表现为无痛性乳头血性溢液，无乳房红肿及腋窝淋巴结肿大。